可用于评价出生后6个月至13岁左右儿童发育情况的发育年龄是
A. 骨骼年龄
B. 牙齿年龄
C. 形态年龄
D. 第二性征年龄
E. 心理年龄

正确答案：B。牙齿年龄